新生儿，临床诊断为双侧完全性唇、腭裂。腭裂术后松弛切口碘仿纱条抽出时间
A. 5～6天
B. 6～7天
C. 8～10天
D. 10～11天
E. 2周以后

正确答案：C。8～10天

解析：本题考查腭裂术后松弛切口碘仿纱条的抽出时间。腭裂术后8～10天（C对）抽出切口的碘仿纱条，有利于肉芽和上皮组织覆盖创面，利于腭部闭合。过早拆除，如5～6天（A错）、6～7天（B错），此时创口周缘的肉芽组织可能未完全形成，则愈合后会形成瘢痕组织，效果不理想。10～11天（D错）抽除，时间过久，影响肉芽和上皮组织覆盖创面，同样不利于术后组织的愈合。术后2周（E错）是拆除腭部创口缝线的时间，若此时才抽除切口的碘仿纱条，会对手术的效果产生极大的影响。